针对女性患者，诊断淋病的金标准是
A. 尿培养
B. 血培养
C. 宫颈管分泌物培养
D. 血清学检查
E. 阴道分泌物培养

正确答案：C。宫颈管分泌物培养

解析：淋菌对柱状上皮及移行上皮黏膜有亲和力，宫颈为柱状上皮，而阴道为鳞状上皮，因而主要侵及宫颈（C对）而不是阴道（E错），诊断淋病的金标准是宫颈管分泌物培养。尿培养（A错）、血培养（B错）以及血清学检查（D错）对淋病不具有确诊意义。